与《执业药师资格制度暂行规定》不符的内容有
A. 执业药师资格考试合格者，由省级医药管理部门颁发《执业药师资格证书》经注册后全国有效
B. 执业药师资格实行注册登记制度，人事部及省级人事（职改）部门为执业药师的注册管理机构
C. 执业药师有权依法开办或领办药品生产、经营企业，执业药师资格证书是申领企业执照的必备文件
D. 凡各级药品生产、经营企业，均应配备执业药师负责有关业务工作，执业药师必须对药品质量负责
E. 一个执业药师只能在一个单位正式执业，并对其所分工的业务负责

正确答案：A、B。执业药师资格考试合格者，由省级医药管理部门颁发《执业药师资格证书》经注册后全国有效；执业药师资格实行注册登记制度，人事部及省级人事（职改）部门为执业药师的注册管理机构

解析：本题考查《执业药师资格制度暂行规定》。根据《执业药师资格制度暂行规定》第十条的规定，执业药师职业资格考试合格者，由各省、自治区、直辖市人力资源社会保障部门（A错，为本题正确答案）颁发《执业药师职业资格证书》。该证书由人力资源社会保障部统一印制，国家药监局与人力资源社会保障部用印，在全国范围内有效。第十条的规定，执业药师实行注册制度。国家药监局（B错，为本题正确答案）负责执业药师注册的政策制定和组织实施，指导全国执业药师注册管理工作。各省、自治区、直辖市药品监督管理部门负责本行政区域内的执业药师注册管理工作。执业药师有权依法开办或领办药品生产、经营企业，执业药师资格证书是申领企业执照的必备文件（C对）。凡各级药品生产、经营企业，均应配备执业药师负责有关业务工作，执业药师必须对药品质量负责（D对）。一个执业药师只能在一个单位正式执业，并对其所分工的业务负责（E对）。